下列哪项目前不属于腹腔镜手术适应证
A. 胆囊切除术
B. 肝叶切除术
C. 淋巴结清扫术
D. 结肠切除术
E. 疝修补术

正确答案：B。肝叶切除术

解析：腹腔镜手术目前仍在探索的手术为胰十二指肠切除（Whipple）手术、解剖性肝切除术、血管动脉瘤切除或转流术等，所以肝叶切除术不属于腹腔镜手术适应证（B对）。腹腔镜手术目前普遍开展的手术为胆囊切除术（A错）、腹腔镜诊断术、阑尾切除术、食管反流手术（Nissen手术）、小肠切除术、脾切除术、肾上腺切除术、淋巴结清扫术（C错）、食管癌、胃癌、结肠、直肠根治切除术（D错）、疝修补术（E错）、肝叶切除术（肿瘤）、胰腺尾部切除术、胆囊空肠吻合术、胃十二指肠溃疡手术等。